卫生防疫机构对公共场所的卫生监督职责不包括下面哪一项
A. 对公共场所进行卫生监督和卫生技术指导
B. 监督从业人员健康检查
C. 指导有关部对从业人员进行卫生知识的教育和培训
D. 指导有关单位开展爱国卫生运动
E. 对新建、扩建、改建的公共场所的选址和设计进行卫生审查，并参加竣工验收

正确答案：D。指导有关单位开展爱国卫生运动